恶心呕吐呃逆嗳气等症频作，其病机是
A. 痰浊上壅
B. 肺气上逆
C. 肝气上逆
D. 胃气上逆
E. 奔豚气逆

正确答案：D。胃气上逆

解析：因寒饮，痰浊，食积停滞于胃，阻碍气机，胃气上逆，则见呃逆、嗳气、恶心、呕吐等症（D对）。痰浊上壅可见耳鸣、头昏、头沉、头重、头闷，耳内胀闷、堵塞感明显、胸闷，纳呆等症（A错）。肺气失于宣发肃降，上逆而致咳嗽、喘息（B错）。肝气上逆多因郁怒伤肝，肝气升发太过，气火上逆则见头痛、眩晕、昏厥，血随气逆而上涌，可导致呕血（C错）。奔豚气逆由于七情内伤，寒水上逆，则见气从少腹上冲胸咽为主要症状特征。常伴见腹痛、胸闷气急、心悸、惊恐、烦躁不安等症（E错）。